属于磺酰脲类胰岛素分泌促进剂的降血糖药物是
A. 那格列奈
B. 盐酸二甲双胍
C. 阿卡波糖
D. 格列吡嗪
E. 盐酸吡格列酮

正确答案：D。格列吡嗪

解析：本题考查磺酰脲类胰岛素分泌促进剂类降糖药。格列吡嗪（D对）是磺酰脲类促胰岛素分泌药。那格列奈（A错）是非磺酰脲类胰岛素分泌促进剂，盐酸二甲双胍（B错）是双胍类胰岛素增敏剂，阿卡波糖（C错）是α-葡萄糖苷酶抑制剂，盐酸吡格列酮（E错）是噻唑烷二酮类胰岛素增敏剂，以上四种均无磺酰脲结构。